便秘虚证刺灸法叙述错误的为
A. 可处方大肠俞、天枢
B. 可处方支沟、上巨虚
C. 气血虚配足三里
D. 阴寒盛配尺泽
E. 一般用平补平泻法

正确答案：D。阴寒盛配尺泽

解析：便秘阴寒盛加神阙、关元（D错，本题为正确答案）。便秘处方穴大肠俞、天枢（A错）归来、支沟、上巨虚（B错）配穴为热秘加合谷、内庭，气秘加中脘、太冲，气虚加脾俞、气海，血虚者足三里（C错）三阴交。便秘用平补平泻法（E错）。